配伍组设计的方差分析中，若总例数为N，处理组数为k，配伍组数为b，则处理组组间变异的自由度等于
A. N－k
B. b－1
C. （b－1）×（k－1）
D. k－1
E. N－1

正确答案：D。k－1